用于急性脑水肿脱水降颅压的是
A. 氢氯噻嗪
B. 布美他尼
C. 甘露醇
D. 螺内酯
E. 乙酰唑胺

正确答案：C。甘露醇

解析：甘露醇（C对）属于渗透性利尿药，是目前降低颅内压安全有效的首选药，该药不易进入脑组织，适用于多种原因如脑瘤、颅脑外伤或组织缺氧等引起的脑水肿。氢氯噻嗪（A错）属于中度利尿药，利尿作用温和、持久，为轻中度心源性水肿的首选药，对肾性水肿疗效与肾功能有关，对肝水肿与螺内酯合用疗效增加。布美他尼（B错）又名丁脲胺，作用较呋塞米强50倍，作为呋塞米的代用品用于顽固性水肿。螺内酯（D错）属于人工合成的抗醛固酮药物，临床配合中高效利尿剂，治疗伴有醛固酮升高的顽固性水肿。乙酰唑胺（E错）属于低效利尿药，作用弱，易产生耐受性，临床仅用于青光眼和轻度脑水肿。